初孕妇，25岁。妊娠31周。从妊娠29周起反复3次阴道流血，量少，无腹痛。再次阴道流血同月经量。查体：P88次/分，BP110/70mmHg。子宫软，无宫缩，枕左前位，胎头高浮，胎心率144次/分。需进行的辅助检查是
A. 测定血雌三醇值
B. 血常规及尿常规
C. B超检查
D. 肛查判断宫颈是否扩张
E. 盆腔X片

正确答案：C。B超检查

解析：青年孕妇，从妊娠29周（妊娠28周左右）起反复3次阴道流血，量少，无腹痛，子宫软，无宫缩，胎头高浮，胎心率144次/分（正常值在110～160bpm），首先考虑为完全性前置胎盘。B超检查可清楚显示子宫壁、胎盘、胎先露部及宫颈的位置，并根据胎盘下缘与宫颈内口的关系，确定前置胎盘类型，故需进行的辅助检查是B超（C对）；测定血雌三醇值（A错）用于评估胎儿胎盘单位功能；血常规及尿常规（B错）为一般性检查；前置胎盘的患者不宜进行肛查判断宫颈是否扩张（D错），以免诱发出血或伤害胎儿；盆腔X片（E错）不能判断前置胎盘及其类型类型，且辐射对胎儿有害。